不属分离鉴定细菌程序的是
A. 细菌分离培养
B. 直接形态学检查
C. 生化反应
D. 抗原和毒力检测
E. 血清中特异抗体检测

正确答案：E。血清中特异抗体检测